膈的腔静脉孔位置高度平
A. 第6胸椎
B. 第7胸椎
C. 第8胸椎
D. 第11胸椎
E. 第12胸椎

正确答案：C。第8胸椎

解析：膈的腔静脉孔位置高度平第8胸椎（C对），平第12胸椎（E错）高度的是膈的主动脉脉孔。